提出“六不治”理念的是谁
A. 扁鹊
B. 张仲景
C. 孙思邈
D. 陈实功
E. 苏耽

正确答案：A。扁鹊

解析：“六不治”：战国时期名医扁鹊提出的医疗主张，扁鹊（A对）认为：人的病证在六种情况下不能治好或者不予治疗，即“骄恣不论于理”、“轻身重财”、“衣食不能适”、“阴阳并藏气不定”、“形羸不能服药”、“信巫不信医”等，是为六不治。这也就间接地强调了医患合作的必要性。